燥热伤津的口味是
A. 口淡
B. 口苦
C. 口涩
D. 口甜
E. 口咸

正确答案：C。口涩

解析：口涩指患者自觉口中有涩味，如食生柿，燥涩不适，属燥热伤津，或脏腑热盛。因燥热伤津，不能濡润口舌之故（C对）。口淡指患者味觉减退，口中乏味，常伴食欲减退，属脾胃虚弱，或寒湿内阻困脾，胃阳气亏虚，运化腐熟功能低下，或寒湿内停，阴不耗液，故口淡不渴（A错）。口苦指患者自觉口中有苦味，见于实热证，尤以心、肝胆火旺者多见。心烦失眠者，常有口苦，乃心火上炎之故；胆汁味苦，故肝火上炎或胆气上泛，皆可致口苦（B错）。口甜指患者口中有甜味感，多与脾胃病有关。若口中甜而黏腻，脘闷不舒，舌苔黄腻者，为脾胃湿热，因湿热内阻，脾胃升降失职，浊气上蒸，故见口甜；若口甜而食少，神疲乏力者，为脾虚，因甘味入脾，脾气虚甘味上泛之故（D错）。口咸指患者自觉口中有咸味，见于肾虚或寒证。因咸入肾，肾阴不足，虚火上炎，又或肾阳亏虚，寒水上泛，皆可令口中有咸味（E错）。